合并闭角型青光眼的前列腺增生患者，不宜选用的药物是
A. 多沙唑嗪
B. 托特罗定
C. 非那雄胺
D. 坦索罗辛
E. 舍尼通(普适泰）

正确答案：B。托特罗定

解析：本题考查托特罗定。不宜选用的药物是托特罗定（B错，为本题正确答案）。多沙唑嗪（A对）不良反应为腹痛、消化不良、恶心、乏力、周围性水肿等，合并闭角型青光眼的前列腺增生患者可选用。非那雄胺（C对）不良反应为性功能影响（阳痿、性欲减退、射精障碍）、乳房不适（乳房增大、乳腺疼痛）和皮疹，合并闭角型青光眼的前列腺增生患者可选用。坦索罗辛（D对）不良反应为失神、意识丧失（发生频率不明），合并闭角型青光眼的前列腺增生患者可选用。舍尼通(普适泰）（E对）主要用于良性前列腺增生，慢性、非细菌性前列腺炎治疗，合并闭角型青光眼的前列腺增生患者可选用。